女，38岁。接触性出血半年。妇科检查外阴阴道无异常，宫颈轻度糜烂，触之易出血。子宫正常大小，双侧附件未触及异常。如检查结果为鳞状上皮内高度病变（HSIL），首选的处理方法是
A. 阴道镜下活检
B. 宫颈锥形切除术
C. 宫颈碘试验
D. 分段诊刮术
E. 宫颈细胞学检查

正确答案：A。阴道镜下活检

解析：患者为中年女性，接触性出血（宫颈癌常表现为接触性出血，即性生活或妇科检查后阴道流血），妇检：宫颈糜烂，触之易出血，考虑为宫颈癌。脱落细胞学检查结果为鳞状上皮内高度病变（HSIL）（鳞状上皮细胞异常LSIL（低度鳞状上皮内病变）及以上者，应行宫颈活组织检查），为明确诊断，首选的处理方法是阴道镜下活检（A对）。宫颈锥形切除术（P307）（B错）适用于子宫颈细胞学检查多次阳性而子宫颈活检阴性者，或子宫颈活检为CINⅡ和CINⅢ需确诊者，或可疑微小浸润癌需了解病灶的浸润深度和宽度等情况。；也适用于阴道镜检查不满意的CINⅡ和所有CINⅢ的治疗。宫颈碘试验（P444）（C错）用复方碘溶液棉球浸湿宫颈，富含糖原的成熟鳞状上皮细胞被碘染成棕褐色，称为碘试验阳性；柱状上皮、未成熟化生上皮、角化上皮及不典型增生上皮不含糖原，涂碘后均不着色，称为碘实验阴性。其主要用于定位可疑病变区域，无诊断意义。分段诊刮术（P420）（D错）适用于绝经后子宫出血或老年患者疑有子宫内膜癌，或需要了解宫颈管是否被累及时。宫颈细胞学检查（P303）（E错）是CIN及早期子宫颈癌筛查的基本方法。